暴露评估是指
A. 对某种食品中可能产生不良健康影响的生物、化学和物理因素的确定
B. 对食品中生物、化学和物理因素所产生的不良健康影响进行定性和/或定量分析
C. 对食用时可能摄入生物、化学、物理因素和其他来源的暴露所作的定性和/或定量评估
D. 根据危害识别、危害特征描述和暴露评估，对产生健康影响的可能性与特定人群中已发生或可能发生不良健康影响的严重性进行定性和/或定量评估及不确定性等综合性描述
E. 以上均不正确

正确答案：C。对食用时可能摄入生物、化学、物理因素和其他来源的暴露所作的定性和/或定量评估